睾丸网
A. 位于睾丸前缘内部
B. 由精曲小管直接汇合而成
C. 由精直小管直接汇合而成
D. 由睾丸输出小管直接汇合而成
E. 无

正确答案：C。由精直小管直接汇合而成

解析：由精直小管直接汇合而成（C对）的为睾丸网。